肾藏精是指藏
A. 脏腑之精
B. 先天之精
C. 后天之精
D. 水谷之精
E. 先天之精和后天之精

正确答案：E。先天之精和后天之精

解析：肾精，即肾藏之精，来源于先天，充养于后天，是肾脏生理活动的物质基础，所以说肾藏精是指藏先天之精和后天之精（E对），而不仅仅只是先天之精或后天之精（BC错），脏腑之精由先天之精与后天之精相融合而成（A错）。水谷之精是由饮食水谷所化生的精微物质（D错）。